在下列氨基酸中疏水性氨基酸是
A. 组氨酸
B. 赖氨酸
C. 谷氨酸
D. 半胱氨酸
E. 丙氨酸

正确答案：E。丙氨酸